女孩，13岁。右上臂隐痛1个月。查体：右上臂局部轻度压痛，无红肿。X线显示右肱骨上段干骺端椭圆形、边界清楚的溶骨性病灶，骨皮质膨胀变薄，无硬化性边缘，首先考虑的诊断是
A. 骨软骨瘤
B. 转移性骨肿瘤
C. 骨巨细胞瘤
D. 骨肉瘤
E. 骨囊肿

正确答案：E。骨囊肿

解析：13岁女童，X线检查示右肱骨上段干骺端椭圆形、边界清楚的溶骨性病灶，骨皮质膨胀变薄，诊断为骨囊肿（E对）。骨软骨瘤（A错）常发生于青少年，多见于长骨干骺端，可见从皮质突向软组织的骨性突起（P774）。转移性骨肿瘤（B错）多见于老年人，本题中患者为12岁女孩（P779）。骨巨细胞瘤（C错）好发于20～40岁，女性略多，好发部位为长骨干骺端和椎体（P776）。骨肉瘤（D错）是一种最常见的恶性肿瘤，好发于青少年，好发部位为干骺端，常形成梭形瘤体，可累及骨膜，X线显示骨膜反应明显，呈侵袭性发展，可见Codman三角或呈“日光射线”形态（P776）。